既息风止痉，又祛风止痒的药是
A. 白僵蚕
B. 蜈蚣
C. 刺蒺藜
D. 地龙
E. 地肤子

正确答案：A。白僵蚕